离子型表面活性剂在溶液中随温度升高溶解度增加，超过某一温度时溶解度急剧增大,这一温度称为
A. F值
B. HLB值
C. Krafft点
D. 昙点
E. F₀值

正确答案：C。Krafft点